以人道主义精神关心爱护患者的医学道德品质是
A. 仁慈
B. 严谨
C. 诚实
D. 公正
E. 奉献

正确答案：A。仁慈

解析：医者的职业美德中反映以人道主义精神关心爱护患者的是仁慈，仁慈最能体现医学人道主义的思想和道德要求，仁慈是长期坚持遵守“医学人道”道德要求所形成的内在医学道德品质（A对）。